紫苏子的功效有
A. 泻肺平喘
B. 润肺下气
C. 和胃降逆
D. 降气化痰
E. 润肠通便

正确答案：D、E。降气化痰；润肠通便

解析：本题考查的是紫苏子的功效。紫苏子的功效有降气化痰（D对）与润肠通便（E对）。紫苏子：【功效】降气化痰，止咳平喘，润肠通便。桑白皮：【功效】泻肺平喘（A错），利水消肿。紫菀：【功效】润肺下气（B错），化痰止咳。枇杷叶：【功效】清肺止咳，降逆止呕。枇杷叶则兼润肺燥，善治燥咳；又能和胃降逆（C错）止呕，治胃热呕吐。